精神科临床常见而重要的精神病性症状是
A. 错觉
B. 幻觉
C. 妄想
D. 思维奔逸
E. 痴呆

正确答案：B。幻觉